与输入血液质量有关的早期输血反应为
A. 酸碱平衡失调
B. 过敏反应
C. 出血倾向
D. 丙型肝炎
E. 疟疾

正确答案：B。过敏反应

解析：若血液质量不好，杂质较多时，输血患者可能发生过敏反应（B对）。过敏反应多发生在输血的数分钟后，也可在输血中或输血后发生。输血常见的酸碱平衡失调（A错）为碱中毒，是由于库存血中的枸橼酸盐在肝中转化成碳酸氢钠引起的，属于大量输血的影响，不属于早期输血反应。大量输血后，由于库存血中的血小板基本已被破坏，凝血因子被稀释和低体温等原因，可导致出血倾向（C错），不属于血液质量问题。丙型肝炎（D错）、疟疾（E错）一般为慢性起病，并非早期输血反应。